关于手-足-口病（HFMD）发病特点描述有误的是
A. 托幼单位是主要流行场所
B. 3岁以下幼儿最易患病
C. 流行无明显的地区性
D. 一年四季均可发病
E. 隆冬时节最易流行

正确答案：E。隆冬时节最易流行

解析：托幼单位是手-足-口病（HFMD）的主要流行场所，3岁以下的幼儿是主要罹患者。手-足-口病的流行无明显的地区性。一年四季均可发病，但夏秋季最易流行。掌握“手-足-口病”知识点。